米非司酮终止早孕的机制是
A. 抗雌激素
B. 抑制子宫收缩
C. 抗孕激素
D. 抑制子宫胶原合成
E. 兴奋子宫肌

正确答案：C。抗孕激素

解析：米非司酮是一种类固醇类的抗孕激素制剂，同时具有抗孕激素及抗糖皮质激素的活性，而没有孕激素、雌激素、雄激素和抗雌激素（A错）活性。主要作用于子宫内膜受体，能与内源性孕酮竞争结合受体，产生较强的抗孕酮作用（C对）。孕酮是维持早孕的主要激素之一，其在体内水平下降，或阻断其作用，可导致流血和流产。米非司酮还能引起蜕膜和绒毛变性，导致出血，阻止胚胎发育，同时能使子宫内膜释放前列腺素，促进宫缩（B错）和软化宫颈，有利于孕产物排出。抑制子宫胶原合成（D错）、兴奋子宫肌（E错）未明确说明。